喉上神经两侧损伤
A. 饮水呛咳
B. 声音低钝
C. 手足抽搐
D. 声音嘶哑
E. 失音

正确答案：A。饮水呛咳

解析：喉上神经内支损伤则喉部粘膜感觉丧失，进食特别是饮水时容易误咽发生呛咳（A对）。声音低钝喉上神经外支损伤会使环甲肌瘫痪，引起声带松弛，音调降低（B错），说话费力。手术时甲状旁腺被误切、挫伤或血供障碍，致血钙浓度降低，引起手足抽搐（C错）。一侧喉返神经损伤可引起声音嘶哑（D错）。双侧喉返神经损伤可导致失音或严重的呼吸困难，甚至窒息（E错）。